香豆素母核的¹H-NMR信号特征有
A. H-3与H-4的偶合常数约为9
B. H-3与H-4的偶合常数约为6
C. H-4的化学位移值为7.5～8.3
D. H-3的化学位移值为6.1～6.4
E. H-3的化学位移值为10.0～11.0

正确答案：A、C、D。H-3与H-4的偶合常数约为9；H-4的化学位移值为7.5～8.3；H-3的化学位移值为6.1～6.4

解析：本题考查的是香豆素的核磁共振谱。香豆素母核的¹H-NMR信号特征有H-3与H-4的偶合常数约为9（A对）、H-4的化学位移值为7.5～8.3（C对）、H-3的化学位移值为6.1～6.4（D对）。